常用于外周血T细胞亚群检测的方法是
A. 流式细胞术
B. MTT法
C. 细胞毒试验
D. 凝集反应
E. 沉淀反应

正确答案：A。流式细胞术